“矫正不良的行为习惯，消除或减少高血压的行为危险因素；定期测量血压，做到早诊断、早治疗”，这一高血压社区健康教育对策主要适用于
A. 高危人群
B. 青少年
C. 高血压患者
D. 社区群众
E. 社区领导

正确答案：A。高危人群